地西泮临床应用为首选用于
A. 癫痫大发作
B. 抑郁症
C. 精神病
D. 慢性疼痛
E. 催眠

正确答案：E。催眠

解析：本题考查地西泮的临床应用。地西泮临床应用为首选用于催眠（E对）。地西泮作用特点为主要延长NREMS的第2期，明显缩短SWS期。因此，药物安全范围较大，由于对REMS的影响较小，故其依赖性和戒断症状较轻，地西泮是目前临床上广泛使用的镇静催眠药。此外，地西泮静脉注射是目前治疗癫痫持续状态的首选药物。